一因车祸受重伤的男子被送去医院急救，因没带押金，医生拒绝为病人办理住院手续，当病人家属拿来钱时，已错过了抢救最佳时机，病人死亡。本案例违背了病人权利的哪一点
A. 享有自主权
B. 享有知情同意权
C. 享有保密和隐私权
D. 享有基本的医疗权
E. 享有参与治疗权

正确答案：D。享有基本的医疗权

解析：患者拥有平等医疗权，平等医疗权应当为患者所享有，必须得到尊重和保障，而医务人员为患者维权是应当的、高尚的，侵权是不容许的、应受谴责的。掌握“医患关系伦理”知识点。